用质谱法测定苷类化合物分子量一般采用
A. EI
B. FAB
C. ESI
D. CI
E. FD

正确答案：B、C、D。FAB；ESI；CI